从事医疗器械网络销售的企业，对植入类医疗器械销售记录的保存时限是
A. 有效期后2年
B. 3年
C. 永久
D. 不少于5年

正确答案：C。永久

解析：本题考查医疗器械网络销售管理要求。从事医疗器械网络销售的企业，对植入类医疗器械销售记录的保存时限是永久（C对）。医疗器械网络销售应当记录医疗器械销售信息，记录应当保存至医疗器械有效期后2年（A错）；无有效期的，保存时间不得少于5年（D错）；植入类医疗器械的销售信息应当永久保存。